离心性心肌肥大的机制是
A. 肌原纤维串联性增生
B. 肌原纤维并联性增生
C. 心肌细胞变大
D. 心肌细胞增生
E. 心脏扩大

正确答案：A。肌原纤维串联性增生

解析：慢性心衰时，机体可通过心室重塑进行代偿。心肌肥大是指心肌细胞体积增大，属于心室重塑的一种，分为向心性肥大和离心性肥大。离心性肥大即当心脏在长期过度的前负荷作用下，舒张期室壁张力持续增加，刺激肌原纤维串联性增生（A对），心肌细胞增长，心腔容积增大。肌原纤维并联性增生（B错）属于向心性肥大的机制。心肌细胞变大（C错）属于心肌肥大的概念，有研究发现心肌肥大到一定程度时可有心肌细胞增生（D错），上述两者均不是离心性心肌肥大的特有机制。